维生素B₆不具有以下哪个性质
A. 水溶液易氧化变色
B. 能和硼酸形成络合物
C. 能和氯亚胺基-2，6-二氯醌试液反应显色
D. 为3，4，5，6位取代的吡啶衍生物
E. 为外消旋混合物

正确答案：E。为外消旋混合物